酚醛树脂塑化液第Ⅲ液是
A. 间苯二酚
B. 甲醛
C. 95％酒精
D. 过饱和的氢氧化钠液
E. 甲酚甲醛

正确答案：D。过饱和的氢氧化钠液

解析：本题考查酚醛树脂塑化液。酚醛树脂塑化液第Ⅲ液是过饱和的氢氧化钠液（D对）。液体根管充填材料主要是FR酚醛树脂，间苯二酚属于其三组分液体的Ⅱ液（A错）；甲醛和95%乙醇属于Ⅰ液（BC错）；氢氧化钠溶液属于Ⅲ液。主要成分为间苯二酚和甲醇（E错），在强碱性条件下能快速聚合成酚醛树脂，在聚合前能很好地充填根管，聚合后能将根管内残留的病原刺激无包埋固定，使其成为无害物质。